医疗用毒性药品
A. 地西泮
B. 哌醋甲酯
C. 盐酸可卡因
D. 去乙酰毛花苷丙
E. 盐酸普鲁卡因

正确答案：D。去乙酰毛花苷丙